下列不属于他汀类不良反应的是
A. 胃肠反应
B. 肌痛
C. 皮肤潮红
D. 头痛
E. 腹胀

正确答案：E。腹胀

解析：他汀类不良反应较少而轻，大剂量应用时患者偶可出现胃肠反应、肌痛、皮肤潮红、头痛等暂时性反应；偶有横纹肌溶解症。掌握“抗动脉粥样硬化药”知识点。